医师行牙髓治疗时应注意无菌操作，包括以下各项，有一项不是必要内容
A. 带一次性手套
B. 剪短指甲
C. 肥皂洗手
D. 消毒毛巾擦手
E. 75％酒精浸泡

正确答案：E。75％酒精浸泡

解析：医师行牙髓治疗时应注意无菌操作不是必要内容的是75％酒精浸泡（E错，为本题的正确答案）。一次性手套为消毒物品，无需再用酒精浸泡。医护人员在为患者治疗前，彻底洗刷双手（C对），用一次性纸巾或小毛巾擦干双手后戴手套（D对），手套为一次性使用（A对）。注意保持指甲平短（B对）。